既祛风通络，又能定惊止痉的是
A. 香加皮
B. 海风藤
C. 络石藤
D. 木瓜
E. 蕲蛇

正确答案：E。蕲蛇

解析：本题考查的是蕲蛇的功效。既祛风通络，又能定惊止痉的是蕲蛇（E对）。蕲蛇：【功效】祛风通络，定惊止痉。香加皮（A错）：【功效】祛风湿，强筋骨，利水消肿。海风藤（B错）：【功效】祛风湿，通经络。络石藤（C错）：【功效】祛风通络，凉血消肿。木瓜（D错）：【功效】舒筋活络，化湿和中，生津开胃。